男性，67岁，肺源性心脏病急性加重期患者。血气分析：pH7.25，PaCO₂9.3kPa（70mmHg），HCO₃⁻30mmol/L。对其酸碱失衡的治疗措施应为
A. 静脉滴注5%碳酸氢纳
B. 静脉滴注盐酸精氨酸
C. 给予利尿剂
D. 补充氯化钾
E. 改善通气功能

正确答案：E。改善通气功能

解析：患者为老年男性，肺源性心脏病急性加重期，血气分析：pH下降（正常值为7.35～7.45）、PaCO₂升高（正常值为35～45mmHg）、HCO₃⁻增高（正常值为22～27mmol/L，此处为代偿性增高），提示为呼吸性酸中毒（呼吸性酸中毒患者常有呼吸功能受影响的病史，血pH下降，PaCO₂增高，血HCO₃⁻亦有增高）。对呼吸性酸中毒的治疗措施应为改善通气功能（E对），迅速排出体内潴留的CO₂，纠正缺氧状态。肺心病患者一般在改善呼吸功能后，心力衰竭便能得到改善，患者尿量增多，水肿消退，因此不需常规使用利尿剂（C错）。静脉滴注5％碳酸氢纳（A错）为重症代谢性酸中毒（血浆HCO₃⁻低于10mmol/L或pH＜7.2）的治疗措施。静脉滴注盐酸精氨酸（B错）为重症代谢性碱中毒（血浆HCO₃⁻45～50mmol/L，pH＞7.65）的治疗措施。补充氯化钾（D错）为低钾血症的治疗措施。